水不溶性包衣材料是
A. 聚乳酸
B. 硅橡胶
C. 卡波姆
D. 明胶-阿拉伯胶
E. 醋酸纤维素

正确答案：E。醋酸纤维素

解析：本题考查包衣膜型缓释材料。醋酸纤维素（E对）属于水不溶性包衣材料；聚乳酸（A错）可生物降解的合成高分子材料；硅橡胶（B错）为非生物降解的囊材；卡波姆（C错）为药用的乳化剂；明胶-阿拉伯胶（D错）为天然高分子囊材。